帕金森病的主要原因是
A. 脑干网状结构胆碱能系统受损
B. 脑桥蓝斑去甲肾上腺素能系统受损
C. 低位脑干5-羟色胺能系统受损
D. 中脑黑质多巴胺能系统受损
E. 纹状体GABA能系统受损

正确答案：D。中脑黑质多巴胺能系统受损

解析：黑质内存在大量多巴胺能神经元，纹状体内存在大量胆碱能神经元，黑质多巴胺递质系统与纹状体乙酰胆碱递质系统之间的功能失衡是帕金森病发病的原因：黑质多巴胺递质系统的作用在于抑制纹状体乙酰胆碱递质系统，当黑质多巴胺神经元受损后（D对），对纹状体内胆碱能神经元的抑制作用减弱，导致乙酰胆碱递质系统功能亢进，进而影响新纹状体传出神经元的活动而引起一系列症状，即帕金森病。